肝十二指肠韧带内有
A. 肝静脉
B. 脾静脉
C. 肝门静脉
D. 胃左静脉
E. 脾动脉

正确答案：C。肝门静脉

解析：肝门静脉（C对）进入肝十二指肠韧带内走行，多由肠系膜上静脉和脾静脉在胰颈后面汇合而成。